不属于牙根纵裂外因的是
A. 过度的根管预备
B. 外伤
C. 饮食习惯
D. 过大根充压力
E. 根管桩

正确答案：C。饮食习惯

解析：本题考查牙根纵裂。不属于牙根纵裂外因的是饮食习惯（C错，为本题正确答案）。牙根纵裂的外因包括外伤（B对）；医源性因素，如无髓牙、过度的根管预备（A对）、根充压力过大（D对）、根管桩（E对）。内因包括解剖结构、所在位置、饮食习惯。